男，54岁，反复脓血便半年，每天3～4次，在当地曾按“痢疾”治疗无明显效果。近一月出现腹胀，伴阵发性腹痛。查体：消瘦，腹稍胀，质软，下腹轻压痛，右下腹可扪及一肿块，质较硬，尚可活动。根据上述资料，应诊断为
A. 慢性菌痢
B. 溃疡性结肠炎
C. 结肠息肉
D. 肠结核
E. 结肠癌

正确答案：E。结肠癌

解析：患者老年男性，脓血便半年，腹泻一月（属于结肠癌高危人群），伴腹痛，腹胀、质硬包块（结肠癌的表现），结合患者病史、症状和体征，应诊断为结肠癌（E对）诊断。慢性菌痢（A错）、溃疡性结肠（B错）、结肠息肉（C错）应无肿块。肠结核（D错）可有低热、盗汗等全身症状，一般粪便不带黏液和脓血。